下列哪种物质不属于第二信使
A. cAMP
B. Ca²⁺
C. cGMP
D. IP₃
E. 乙酰胆碱

正确答案：E。乙酰胆碱